医疗机构在发现甲类传染病时，对疑似病人在明确诊断前，应在指定场所进行
A. 访视
B. 留验
C. 单独隔离治疗
D. 医学观察
E. 就地诊验

正确答案：C。单独隔离治疗

解析：医疗机构发现甲类传染病时，应当及时采取下列措施：①对病人、病原携带者，予以隔离治疗，隔离期限根据医学检查结果确定；②对疑似病人，确诊前在指定场所单独隔离治疗（C对）；③对医疗机构内的病人、病原携带者、疑似病人的密切接触者，在指定场所进行医学观察和采取其他必要的预防措施。对于拒绝隔离治疗或者隔离期未满擅自脱离隔离治疗的，可以由公安机关协助医疗机构采取强制隔离治疗措施。